患儿，2岁。咳嗽2周，日轻夜重，咳后伴有深吸气样鸡鸣声，吐出痰涎或食物后暂时缓解，不久又复发作，昼夜达十余次，舌质红，舌苔黄，脉滑数。治疗应首选
A. 桑白皮汤合葶苈大枣泻肺汤
B. 苏子降气汤合黛蛤散
C. 麻杏石甘汤合苏葶丸
D. 麻黄汤合葶苈大枣泻肺汤
E. 泻白散合黛蛤散

正确答案：A。桑白皮汤合葶苈大枣泻肺汤

解析：题中患儿咳嗽，日轻夜重，咳后伴有深吸气样鸡鸣声故诊断为百日咳，吐出痰涎或食物后暂时缓解，不久又复发作，昼夜达十余次，诊断为痰火阻肺型，即处于痉咳期。方选桑白皮汤合葶苈大枣泻肺汤（A对）。苏子降气汤合黛蛤散用于治疗哮喘肺实肾虚证，功能泻肺补肾（B错）。麻杏石甘汤合苏葶丸为热性哮喘的选方，功能清肺涤痰，止咳平喘。（C错）。麻黄汤合葶苈大枣泻肺汤功能解表散寒，泻肺平喘（D错）。泻白散合黛蛤散治疗肝火犯肺证，能清肺泻肝，化痰止咳（E错）。